雌激素的生理作用错误的是
A. 促进子宫发育
B. 促进水和钠的排泄
C. 促进输卵管发育
D. 促进骨钙沉积
E. 促进阴道上皮细胞增生

正确答案：B。促进水和钠的排泄

解析：高浓度的雌激素可使体液向组织间隙转移，由于循环血量减少而引起醛固酮分泌，促进肾小管对钠和水的重吸收，导致钠、水潴留（B错，为本题正确答案）。雌激素能促进子宫（A对）、输卵管（C对）的发育和成熟。雌激素可刺激成骨细胞活动，促进骨中钙的沉积，增加骨骼坚硬度（D对）。雌激素可使阴道黏膜上皮细胞增生（E对）。